开创内伤杂病辨证论治体系的医学典籍是
A. 《伤寒论》
B. 《金匮要略》
C. 《千金翼方》
D. 《外台秘要》
E. 《太平圣惠方》

正确答案：B。《金匮要略》

解析：本题考查的是主要医学典籍的意义。开创内伤杂病辨证论治体系的医学典籍是《金匮要略》（B对）。《金匮要略方论》：简称《金匮要略》《金匮》。汉·张机（字仲景）撰著。全书以《内经》理论为指导，理论联系实际，开创了内伤杂病辨证论治的体系，对后世临床医学的发展有深远影响。《伤寒论》（A错）：简称《伤寒》，汉·张机（字仲景）撰著。全书10卷，共22篇。书中总结了先秦两汉时代的医学成就，继承与发展了《内经》的基本理论，创造性地将医学理论与临床实践紧密结合。《千金翼方》（C错）：唐•孙思邈撰著于公元682年。该书是《千金要方》的续编，与《千金要方》相辅相成。全书30卷。该书与《千金要方》对后世中医学发展具有重要的影响。《外台秘要》（D错）：唐·王焘编撰。该书是继《备急千金要方》后又一部综合性医学巨著，为医学史的研究提供了不少珍贵资料。该书采摭古方，广博而实效，并收集许多民间单方验方，记载其疗效和应用范围。《太平圣惠方》（E错）：宋·王怀隐等编。该书以临床实用为目的，首详诊脉辨阴阳法，次叙处方用药法则，然后按科分叙各科病证和病因、病理以及方药的适应证和药物剂量。因证设方，药随方施，理法方药兼收并蓄。